患者，男，50岁。1周前项后发际处突发一肿块，红肿热痛，渐渐加剧，其后出现多个粟米样脓头，部分溃破溢脓。其治法是
A. 凉血祛风，行瘀通络
B. 凉血清热，解毒利湿
C. 和营托毒，清热利湿
D. 清热解毒，活血通络
E. 养阴清热，托毒透邪

正确答案：C。和营托毒，清热利湿

解析：本患者项后发际处突发一肿块，红肿热痛，渐渐加剧，其后出现多个粟米样脓头，部分溃破溢脓，符合有头疽的特点。有头疽是发生于肌肤间的急性化脓性疾患。可分为初期，溃脓期及收口期。本患者脓头部分溃破溢脓，为溃脓期，在治疗上，宜和营托毒、清热利湿，用仙方活命饮加减（C对）。凉血祛风，行瘀通络不适合，因为患者肿块红肿热痛兼见脓头溃破，未有瘀血阻络，也未有风邪侵袭的症状（A错）。凉血清热，解毒利湿用于猫眼疮之火毒炽盛证（B错）。清热解毒，活血通络用于流注之初起，方选翁连解毒汤合五神汤加减（D错）。养阴清热托毒，透邪用于流痰之阴虚内热证（E错）。